产后不哺乳妇女通常可于产后几周月经复潮
A. 6～8周
B. 2～3周
C. 4个月
D. 5个月
E. 6个月

正确答案：A。6～8周

解析：产褥期恢复排卵与月经复潮的时间受哺乳影响，不哺乳产妇通常于产后6～8周月经复潮，平均在产后10周左右恢复排卵。而哺乳产妇的月经复潮延迟，平均在产后4～6个月恢复排卵，也有哺乳期月经一直不潮者。产后较晚恢复月经者，首次月经来潮前多有排卵，故哺乳期妇女未见月经来潮仍有可能怀孕（A对）。